甲氧苄啶的作用机理为
A. 抑制二氢叶酸合成酶
B. 抑制二氢叶酸还原酶
C. 抗代谢作用
D. 掺入DNA的合成
E. 抑制β-内酰胺酶

正确答案：B。抑制二氢叶酸还原酶

解析：本题考查甲氧苄啶。甲氧苄啶是二氢叶酸还原酶可逆性抑制剂，能够抑制二氢叶酸还原酶（B对）。抑制二氢叶酸合成酶（A错）的为磺胺类药物。抗代谢药（C错）是指能与体内代谢物发生特异性结合，从而影响或拮抗代谢功能的药物，如甲氨蝶呤。掺入DNA合成（D错）的药物一般为周期特异性药物，如叶酸、嘌呤碱等。抑制β-内酰胺酶（E错）的药物有克拉维酸和舒巴坦。